热衰竭的发病机制可能是
A. 体温调节障碍
B. 脑部受热引起充血水肿
C. 神经系统功能紊乱
D. 水、电解质平衡紊乱
E. 外周血管扩张和失水造成血循环量不足，引起脑缺血

正确答案：E。外周血管扩张和失水造成血循环量不足，引起脑缺血